某男，40岁。嗜食肥甘厚味，喜好饮酒，形体肥胖，检查结果：总胆固醇8.22mmol/L，引起该指标升高的疾病不包括
A. 高脂血症
B. 消耗性疾病
C. 阻塞性黄疸
D. 肾病综合征
E. 甲状腺功能减退症

正确答案：B。消耗性疾病

解析：本题考查的是总胆固醇的临床意义。消耗性疾病可导致总胆固醇指标降低（B错，为本题正确答案）。总胆固醇（TC）：TC是脂质的重要组成部分，其中70%是胆固醇酯，30%是游离胆固醇。肝脏是合成、储存和供给胆固醇的主要器官，血清TC的水平易受饮食、年龄和性别等多种因素影响。血清TC升高时引起动脉粥样硬化（AS）、缺血性心脑血管病的重要危险因素。血清TC升高和降低都有临床意义。（一）参考值：合适水平：＜5.20mmol/L；边缘水平：5.18～6.20mmol/L；升高：＞6.20mmol/L。（二）临床意义：1.升高：（1）血脂异常：高胆固醇血症或混合型高脂血症（A对）。（2）其他疾病：糖尿病、甲状腺功能减退症（E对）、肾病综合征（D对）以及阻塞性黄疸（C对）等。（3）应用某些药物：如糖皮质激素、环孢素、阿司匹林、口服避孕药等。（4）长期高脂饮食。2.降低：见于甲状腺功能亢进症、严重贫血、急性感染及消耗性疾病等。